动物在由低级向高级发展过程中的特点是
A. 牙根数目减少
B. 牙根长度增加
C. 牙体数目由多变少
D. 牙尖高度降低
E. 磨牙逐渐前移

正确答案：C。牙体数目由多变少

解析：本题考查牙的演化。牙演化的特点：①牙形由单一同形牙向复杂异形牙演化；②牙数目由多变少（C对）；③牙的替换次数由多牙列向双牙列演化；④牙的分布由广泛至逐渐集中于上、下颌骨；⑤牙根从无到有（A错），牙附着于颌骨的方式由端生牙至侧生牙，最后向槽生牙演化。